女性，65岁。近一年来大便次数增多、伴腹泻，腹泻便秘交替出现，偶有血便，一天前突发上腹部疼痛，呈阵发性加重，伴恶心、无呕吐，查体：体温37.5℃，血压100/70mmHg，上腹正中可触及一大小约5cm包块，全腹轻压痛，无反跳痛、无肌紧张。确诊后最适合的手术方式是
A. 根治性远端胃大部切除术
B. 胰体尾切除
C. 横结肠切除
D. 肝左叶切除
E. 胰十二指肠切除

正确答案：C。横结肠切除

解析：老年女性患者，排便次数增多、腹泻、便秘、便中带血（结直肠癌常见症状），上腹部疼痛，呈阵发性加重，上腹正中可触及一大小约5cm包块，最可能的诊断为横结肠癌。确诊后最适合的手术方式是横结肠切除（C对）。